女，42岁，经常于清晨或空腹后出现乏力、心慌、冷汗，重者神智不清，抽搐、昏迷。可于进食或口服、静点葡萄糖后缓解。发作时测血糖常低于2.5mmol/L。该病人最可能的诊断是
A. 胃泌素瘤
B. 胰岛素瘤
C. 心血管疾病
D. 脑血管疾病
E. 癫痫

正确答案：B。胰岛素瘤

解析：该患者清晨空腹后出现低血糖症状，进食或口服、静点葡萄糖后缓解，发作时测血糖常低于2.5mmol/L，具有典型的Whipple三联症，最可能的诊断是胰岛素瘤（B对）。心血管疾病（C错）主要表现为疼痛、高血压或低血压、呼吸困难、眩晕或晕厥、水肿；脑血管疾病（D错）主要表现为偏瘫、眩晕、单侧肢体运动不灵活、头痛或恶心呕吐、平衡能力失调、站立不稳；癫痫（E错）发作时表现为知觉丧失、牙关紧闭、四肢抽搐、直至大小便失禁等。以上三种疾病发病时均不会出现低血糖。胃泌素瘤（P467）（A错）为来源于G细胞的肿瘤，主要表现为顽固性消化性溃疡和腹泻。